阳虚证的主要症状是
A. 面色萎黄，四肢倦怠
B. 时而汗出，动则加重
C. 冷汗淋漓，四肢厥冷
D. 畏寒肢冷，面色㿠白
E. 呕秽水泻，脘腹胀痛

正确答案：D。畏寒肢冷，面色㿠白

解析：本题考查的是阳偏衰的临床表现。阳虚证的主要症状是畏寒肢冷，面色㿠白（D对）。阴虚与阳虚：阴虚与阳虚，是指机体阴阳亏损而导致的阴不制阳、阳不制阴的阴虚证和阳虚证候。阴虚证的临床表现，除见形体消瘦、口燥咽干、眩晕失眠、舌红脉细数等阴液不足的症状外，还常伴见五心烦热、潮热盗汗、舌红绛、脉数等阴不制阳、虚热内生的症状。阳虚证的临床表现，除见神疲乏力、少气懒言、蜷卧嗜睡、脉微无力等气虚功能衰减的症状外，还常兼见畏寒肢冷、口淡不渴、尿清便溏或尿少肿胀、面白舌淡等阳不制阴、水寒内盛的症状。面色萎黄，四肢倦怠（A错）为脾气虚证的症状。脾气虚证的临床表现及辨证要点：由于素体虚弱，劳倦与饮食不节等，内伤脾气，以致脾气虚弱。临床上常见脾虚证候可分三类：（1）脾失健运证：临床表现常见食纳减少，食后作胀，或肢体浮肿，小便不利，或大便溏泻，时息时发，并伴有身倦无力、气短懒言、面色萎黄、舌质淡嫩、苔白、脉缓弱。（2）脾虚下陷证：临床表现常见子宫脱垂，脱肛，胃下垂，慢性腹泻，并见食纳减少，食后作胀，少腹下坠，体倦少气，气短懒言，面色萎黄，舌淡苔白，脉虚。（3）脾不统血证：临床表现常见面色苍白或萎黄，饮食减少，倦怠无力，气短，肌衄，便血以及妇女月经过多，或崩漏，舌质淡，脉细弱。时而汗出，动则加重（B错）为心阳虚与心气虚证的共有症状、冷汗淋漓，四肢厥冷（C错）为心阳虚脱的临床表现。心气虚证与心阳虚证的临床表现及辨证要点：心阳虚与心气虚的共有症状是：心悸，气短，自汗，活动或劳累后加重。心气虚证的临床表现，除上述共有症状外，兼见面色白、体倦乏力、舌质淡、舌体胖嫩、苔白、脉虚。心阳虚证的临床表现，除上述共有症状外，兼见形寒肢冷、心胸憋闷、面色苍白、舌淡或紫暗脉细弱或结代。如出现心阳虚脱，除有心阳虚的症状外，兼见大汗淋漓、四肢厥冷、口唇青紫、呼吸微弱、脉微欲绝。呕秽水泻，脘腹胀痛（E错）为脾胃不和证的症状。脾胃不和：胃主受纳与脾主运化相互影响，胃之受纳失常则脾之运化不利，脾失健运则胃纳失常，出现恶心呕吐、脘腹胀满、不思饮食等。